产褥妇，26岁。剖宫产术后16天，突然阴道大量流血3小时来院。入院时BP84/60mmHg，心率122次/分，Hb84g/L。该患者最有效的处理措施是
A. 宫腔镜检查并止血
B. 剖腹探查，若切口周围组织坏死范围小，则清创缝合
C. 剖腹探查，行子宫次全切除术
D. 剖腹探查，行子宫全切除术
E. 清宫术

正确答案：B。剖腹探查，若切口周围组织坏死范围小，则清创缝合

解析：该产褥妇，剖宫产术后16日（＞24小时），突然阴道大量流血3小时来院，入院时BP84/60mmHg（血压低于90/60mmHg为低血压），心率122次/分（正常心率为60～100次/分，该患者心动过速），Hb84g/L（正常血红蛋白含量为115～150g/L），诊断为晚期产后出血。患者大量出血引起休克和继发性贫血，此时最有效的处理措施是剖腹探查，若切口周围组织坏死范围小，则清创缝合（B对A错）。若组织坏死范围大，酌情作低位子宫次全切除术（C错）或子宫全切除术（D错）。疑有胎盘、胎膜、蜕膜残留或胎盘附着部位复旧不全者，静脉输液、备血及准备手术的条件下行清宫术（E错），刮出物应送病理检查，已明确诊断。